男，40岁。出现排尿后尿道灼痛并溢出白色黏液6个月。会阴部及腰背都酸痛，性欲减退，乏力。前列腺按摩液检查：卵磷脂小体少量，白细胞20~30/HP。首先考虑的疾病是
A. 膀胱炎
B. 尿道炎
C. 尿路结石
D. 慢性前列腺炎
E. 肾结核

正确答案：D。慢性前列腺炎

解析：中年男性患者，排尿后尿道灼痛，溢出白色黏液（滴白），会阴部及腰背酸痛，性欲减退，乏力。前列腺按摩液检查：卵磷脂小体少量，白细胞20~30/HP。首先考虑的疾病是慢性前列腺炎（D对）。